患者，男性，35岁，1小时前从二楼跌下，颏部着地，不省人事数分钟后清醒。检查：神志清楚，呼吸急促，口唇发绀，鼻翼煽动，下唇及下颌2—2间牙龈撕裂，下颌弓变窄，舌体后坠，口底血肿形成。最可能并发的颅脑损伤是
A. 颅骨骨折
B. 脑震荡
C. 脑挫裂伤
D. 硬膜外血肿
E. 脑脊液漏

正确答案：B。脑震荡

解析：脑震荡是头面部外伤后即刻发生的短暂性意识障碍，是轻度的脑损伤。如果出现昏迷-清醒-再昏迷的情况，则提示有颅内血肿的可能。掌握“牙槽突骨折、颌骨骨折”知识点。